医务人员发生医疗事故，情节严重，尚不够刑事处罚的，卫生行政部门可以给予的行政处罚是
A. 警告
B. 给予纪律处分
C. 责令限期整顿
D. 吊销执业证书
E. 责令改正

正确答案：D。吊销执业证书

解析：《执业医师法》规定，医师在执业活动中，违反本法规定，造成医疗事故的，由县级以上人民政府卫生行政部门给予警告（A错）或者责令暂停6个月以上1年以下执业活动（CE错）；情节严重的，吊销执业证书（D对）；构成犯罪的，依法追究刑事责任。